五脏的生理功能特点是
A. 似脏非脏，似腑非腑
B. 藏精气，藏而不泻
C. 传化水谷，传化物而不藏
D. 既藏精气又传化水谷
E. 以上均不是

正确答案：B。藏精气，藏而不泻

解析：五脏的生理特点是化生和储藏精气（B对）；“似脏非脏，似腑非腑”指的是奇恒之腑（A错）；传化水谷，传化物而不藏是六腑的生理特点（C错）；既藏精气又传化水谷是脾（DE错）。